无症状性细菌尿最常见的致病菌是
A. 粪肠球菌
B. 大肠埃希菌
C. 葡萄球菌
D. 铜绿假单胞菌
E. 变形杆菌

正确答案：B。大肠埃希菌

解析：无症状细菌尿是一种隐匿性尿感，即患者有菌尿而无任何尿感症状，常在健康人群进行筛选时，或因其他慢性肾脏病做尿常规细菌学检查时发现。无症状细菌尿来自于膀胱和肾，其致病菌多为大肠埃希菌（B对）。